男，48岁。右季肋区疼痛3月。既往有乙型病毒性肝炎病史10年。B超检查见肝右叶巨大肿块。血AFP增高。符合该肿瘤病理学特点的是
A. 肿瘤组织间质较多
B. 癌细胞呈腺管状排列
C. 癌细胞分泌黏液且血管少
D. 癌细胞与肝细胞类似
E. 发生于肝内胆管上皮最多见

正确答案：D。癌细胞与肝细胞类似

解析：患者中年男性（好发人群），右季肋区疼痛3月（肝区疼痛）。既往有乙型病毒性肝炎病史10年（常见肝癌前诱因）。B超检查见肝右叶巨大肿块（肝癌影像学表现）。血AFP增高（肝细胞癌指标）。结合患者病史、临床表现及辅助检查结果，提示该患者病毒性肝炎发生恶变，转化为原发性肝癌（肝细胞癌），其病理特征为：癌细胞与肝细胞类似（D对）。肿瘤组织间质较多（A错）、癌细胞呈腺管状排列（B错）、癌细胞分泌黏液且血管少（C错）、发生于肝内胆管上皮最多见（E错）均为胆管细胞癌的病理特征（ABCE错）。